根据苷键原子分类原则，属于氧苷的有
A. 酯苷
B. 醇苷
C. 酚苷
D. 氰苷
E. 吲哚苷

正确答案：A、B、C、D、E。酯苷；醇苷；酚苷；氰苷；吲哚苷

解析：本题考查的是苷键原子的分类。根据苷键原子分类原则，属于氧苷的有酯苷（A对）、醇苷（B对）、酚苷（C对）、氰苷（D对）、吲哚苷（E对）。氧苷（O-苷）以苷元不同又可分为醇苷、酚苷、氰苷、酯苷和吲哚苷。